两面嵌体不常用作固定桥固位体的主要原因是
A. 固位力差
B. 就位困难
C. 影响美观
D. 难于制作
E. 机械强度低

正确答案：A。固位力差

解析：双面嵌体属于冠内固位体，因受到牙体组织的限制，固位力较弱，而其外形线较长，是防龋的薄弱环节。适合缺牙间隙窄，咬合力小，对固位力要求不高者。掌握“固定桥的设计”知识点。